某蓄电池厂，男工，工龄8年，主诉头昏、头痛、乏力、记忆减退、睡眠障碍、纳差、脐周隐痛，经检验，尿中6-ALA为28.6μmol/L。最可能的诊断为
A. 慢性铅中毒
B. 慢性苯中毒
C. 慢性汞中毒
D. 慢性氰化物中毒
E. 慢性硫化氢中毒

正确答案：A。慢性铅中毒

解析：男性患者，有长期接触铅的职业史，出现头昏头痛、乏力、记忆减退、睡眠障碍等神经衰弱表现和纳差伴脐周隐痛等消化系统表现（慢性铅中毒的典型表现），实验室检查尿中ALA增高（慢性铅中毒干扰血红素合成可导致ALA无法转变为卟胆原，血及尿ALA升高），最可能的诊断为慢性铅中毒（A对）。慢性苯中毒（B错）多见于长期吸入苯蓄积的人群如制鞋工人，可出现头昏头痛、失眠、乏力、多梦等神经衰弱症状，血液系统变化为其主要表现，开始先有白细胞减少，后出现贫血和血小板减少，一般无消化系统表现，尿ALA多降低。慢性汞中毒（C错）主要发生在生产活动中，长期吸入汞蒸汽和汞化合物粉尘所致，以精神-神经异常、齿龈炎及震颤为主要症状，尿ALA多正常。慢性氰化物中毒（D错）多见于电镀厂工人，可出现头晕、头痛、嗜睡、注意力分散等神经系统表现以及恶心、呕吐、胃灼热感等消化系统表现，但尿ALA正常。慢性硫化氢中毒（E错）多见于采煤、印染等工人中，可出现神经系统及呼吸系统表现，但尿ALA正常。